盐酸美沙酮含有
A. 吗啡喃结构
B. 苯吗喃结构
C. 哌啶结构
D. 氨基酮结构
E. 环己基胺结构

正确答案：D。氨基酮结构

解析：本题考查氨基酮类镇痛药。盐酸美沙酮含有氨基酮结构（D对）。美沙酮为阿片受体非环状配体，是一个高度柔性分子，由于羰基极化，碳原子上带有部分正电荷，与氨基氮原子上孤对电子相互吸引，通过非共价键的相互作用可使之与哌替啶构象相似，可以看作是开环的哌啶类化合物。吗啡喃类化合物是吗啡分子去除E环（呋喃环）后的衍生物。结构中B/C环呈顺式，C/D环呈反式，与吗啡立体结构相同，美沙酮不含吗啡喃结构（A错）。进一步简化吗啡喃的结构，打开C环，仅保留A、B、D 环，形成苯并吗喃类（B错），C环裂开后在原处保留小的烃基作为C环残基，立体构型与吗啡更相似，镇痛作用增强。哌啶类药物结构（C错）比吗啡大大简化，只保留吗啡结构的A环和D环，可以看作吗啡碱A、D 环类似物。环己基胺又称六氢苯胺，美沙酮不含环己基胺结构（E错）。